在预防新技术培训班，老师介绍了非创伤性修复治疗，学员们对这项技术错误的认识是
A. 患者易于接受
B. 不需要钻牙
C. 医生容易操作
D. 充填材料可以释放氟离子
E. 适用于浅、中、深龋洞

正确答案：E。适用于浅、中、深龋洞

解析：非创伤新修复治疗（ART）适用于恒牙和乳牙的中小龋洞，能允许最小的挖器进入；无牙髓暴露，无可疑牙髓炎。掌握“非创伤性修复治疗”知识点。